复合性牙周炎指
A. 既有局部损害又有全身损害
B. 既有骨上袋也有骨下袋
C. 龈炎牙周炎同时存在
D. 炎症损害与创伤同时存在
E. 以上均不对

正确答案：D。炎症损害与创伤同时存在

解析：本题考查复合性牙周炎。复合性牙周炎指炎症损害与创伤同时存在（D对）。复合性牙周炎指单纯性成人牙周炎伴有较明显的（牙合）创伤者，（牙合）创伤可以是原发的，也可以是继发的。单纯的（牙合）创伤不会引起牙周组织炎症及形成牙周袋，但当牙周炎伴有（牙合）创伤时，可加速和加重牙周组织的破坏，因此菌斑是复合性牙周炎的主要病因，（牙合）创伤是辅加因素。